甲药品零售企业的经营类别有：药品、医疗器械、保健食品，其《药品经营许可证》的经营范围有：中药饮片、中成药、化学药制剂、抗生素制剂。2016年初，甲企业的采购人员发现本企业一直可以购进的A药不能再购进了，经查实，A药属于2015年新列入《兴奋剂目录》的肽类激素，同时发现库存还有A药20盒（都在有效期内）。另外，本企业仓库保管人现新购进的B药的包装标签与现库存该药品的包装标签不同，新购进的B药包装新增了“运动员慎用”的字样。甲企业现有库存老包装的B药40盒（在有效期内）。根据《国家食品药品监督管理总局关于兴奋剂目录调整后有关药品管理的通告》及上还信息，关于甲企业库存20盒A药的处理方式的说法，正确的是
A. 在2015年版《兴奋剂目录》发布后不得继续销售
B. 将20盒A药按规定销售至医疗机构
C. 在有效期内可以继续销售和使用，严格按处方药管理
D. 20盒A药应在药品监督管理部门监督下销毀

正确答案：C。在有效期内可以继续销售和使用，严格按处方药管理

解析：本题考查蛋白同化制剂、肽类激素的销售及使用管理。甲药品零售企业的经营类别有：药品、医疗器械、保健食品，其《药品经营许可证》的经营范围有：中药饮片、中成药、化学药制剂、抗生素制剂。2016年初，甲企业的采购人员发现本企业一直可以购进的A药不能再购进了，经查实，A药属于2015年新列入《兴奋剂目录》的肽类激素，同时发现库存还有A药20盒（都在有效期内）。另外，本企业仓库保管人现新购进的B药的包装标签与现库存该药品的包装标签不同，新购进的B药包装新增了“运动员慎用”的字样。甲企业现有库存老包装的B药40盒（在有效期内）。根据《国家食品药品监督管理总局关于兴奋剂目录调整后有关药品管理的通告》及上还信息，关于甲企业库存20盒A药的处理方式的说法，正确的是在有效期内可以继续销售和使用，严格按处方药管理（C对）。根据《国家食品药品监督管理总局关于兴奋剂目录调整后有关药品管理的通告》（2015年第54号）的要求，自兴奋剂目录发布执行之日起，不具备蛋白同化制剂和肽类激素经营资格的药品经营企业不得购进目录所列蛋白同化制剂和肽类激素，之前购进的新列入兴奋剂目录的蛋白同化制剂和肽类激素，应当按照《反兴奋剂条例》规定销售至医疗机构（B错），蛋白同化制剂、肽类激素的生产企业或批发企业。药品零售企业已购进的新列入兴奋剂目录的蛋白同化制剂和肽类激素可以继续销售（A错），但应当严格按照处方药管理，处方保存2年。